长期使用可使受体增敏，停药后岀现“反跳”现象的药物是
A. 地塞米松
B. 罗格列酮
C. 普萘洛尔
D. 胰岛素
E. 异丙肾上腺素

正确答案：C。普萘洛尔

解析：本题考查药物的作用与受体。长期使用可使受体增敏，停药后岀现“反跳”现象的药物是普萘洛尔（C对）。普萘洛尔是具有氨基醇结构的β受体阻滞剂，为非选择性β-受体阻断药，能够阻断心肌的β受体，对β₁和β₂受体均有拮抗作用。临床用于高血压、心绞痛、室上性快速心律失常、室性心律失常的等。长期应用普萘洛尔治疗高血压、心绞痛等，可使β受体密度上调而对内源性去甲肾上腺素能神经递质的敏感性增高，如突然停药，则会出现血压升高或心绞痛发作。地塞米松（A错）为强效糖皮质激素，用于神经性皮炎、慢性湿疹、扁平苔藓、局限性硬皮病等。罗格列酮（B错）为胰岛素增敏剂，可使胰岛素对受体靶组织的敏感性增加，减少肝糖的产生。胰岛素（D错）临床主要用于治疗高血糖。胰岛素可降低血糖水平，1型糖尿病的主要病因是胰岛素分泌的绝对缺乏，必须用胰岛素终身治疗；2型糖尿病患者在生活方式和口服降糖药联合治疗的基础上，如果血糖仍然未达到控制目标，即可开始口服药物和胰岛素的联合治疗。异丙肾上腺素（E错）为β受体激动剂，用于支气管哮喘及心脏房室传导阻滞，目前临床上应用比较广泛。